在非处方药中仅限定于外用和塞肛，不能口服的药品是
A. 布洛芬
B. 溴丙胺太林
C. 吲哚美辛
D. 对乙酰氨基酚
E. 阿苯片

正确答案：C。吲哚美辛